关于麻疹皮疹特点的下列说法中错误的是
A. 发热3～4天出疹
B. 出疹与退疹都按同样的顺序
C. 多为充血性皮疹
D. 疹间多有正常皮肤
E. 皮疹消退后不脱屑、无色素沉着

正确答案：E。皮疹消退后不脱屑、无色素沉着